可显示腮腺导管系统及腺实质的侧位影像的是
A. 腮腺造影侧位片
B. 腮腺造影后前位片
C. 下颌下腺造影侧位片
D. 唾液腺分泌功能片
E. 以上均不正确

正确答案：A。腮腺造影侧位片

解析：本题考查唾液腺造影技术。可显示腮腺导管系统及腺实质的侧位影像的是腮腺造影侧位片（A对）。腮腺造影侧位片，可显示腮腺导管系统及腺实质的侧位影像。